治疗虚劳阴虚证，宜选用的方剂是
A. 桂附地黄丸
B. 四物汤
C. 附子理中丸
D. 四君子汤
E. 沙参麦冬汤

正确答案：E。沙参麦冬汤

解析：本题考查的是虚劳的辨证论治。治疗虚劳阴虚证，宜选用的方剂是沙参麦冬汤（E对）。虚劳又称虚损，是以脏腑亏损、气血阴阳虚衰，久虚不复成劳为主要病机，以五脏虚证为主要临床表现的多种慢性虚弱证候的总称。（一）气虚证：【方剂应用】基础方剂为四君子汤（D错）（人参、白术、茯苓、炙甘草）加减。（二）血虚证：【方剂应用】基础方剂为四物汤（B错）（熟地黄、当归、川芎、芍药）加减。（三）阴虚证：【方剂应用】基础方剂为沙参麦冬汤（沙参、玉竹、生甘草、冬桑叶、麦冬、白扁豆、天花粉）加减。（四）阳虚证：【方剂应用】基础方剂为附子理中汤（C错）（附子、人参、白术、甘草、干姜）加减。桂附地黄丸（A错）为肾虚腰痛的中成药应用。肾虚腰痛：【中成药应用】常用中成药有左归丸、鱼鳔丸、七宝美髯丸、腰痛片、杜仲补天素片、桂附地黄丸（水蜜丸）、济生肾气丸（水蜜丸）、杜仲颗粒。